下丘脑-垂体-卵巢轴的启动中心是
A. 下丘脑
B. 卵巢
C. 垂体
D. 子宫
E. 甲状腺

正确答案：A。下丘脑

解析：本题考查女性生殖系统生理。下丘脑（A对）是下丘脑-垂体-卵巢轴的启动中心。